下列选项不属于剂量-反应关系研究在毒理学中的意义的是
A. 有助于发现化学物的毒效应性质
B. 所得到的有关参数可用于比较不同化学物的毒性
C. 有助于发现新的靶器官
D. 有助于确定机体易感性分布

正确答案：C。有助于发现新的靶器官

解析：本题考查剂量-反应关系研究在毒理学中的意义。剂量反应关系是指外源化学物作用于生物体的剂量与引起的生物学改变的发生率或作用强度之间的相互关系。剂量-反应关系研究在毒理学中的意义有：1.有助于发现化学物的毒效应性质（A对）；2.所得到的有关参数可用于比较不同化学物的毒性（B对）；3.有助于确定机体易感性分布（D对）。有助于发现新的靶器官（C错，为本题正确答案）不属于剂量-反应关系研究在毒理学中的意义。